治疗氨基甲酸酯类农药中毒一般使用
A. 胆碱酯酶复能剂
B. 阿托品
C. 对症治疗
D. 阿托品加对症治疗
E. 阿托品加胆碱酯酶复活药加对症治疗

正确答案：D。阿托品加对症治疗